兼具抗幽门螺杆菌作用的抗酸药是
A. 氢氧化铝
B. 米索前列醇
C. 西咪替丁
D. 哌仑西平
E. 奥美拉唑

正确答案：E。奥美拉唑